关于产后出血的定义下述哪项是正确的
A. 分娩过程中出血量＞500ml
B. 胎盘娩出后24小时内阴道流血量超过500ml
C. 胎儿娩出后24小时内阴道流血量超过500ml
D. 产后24小时到产后10天阴道出血＞500ml
E. 胎儿娩出后，阴道流血＞500ml

正确答案：C。胎儿娩出后24小时内阴道流血量超过500ml